患儿，3岁，面色少华，不思纳食，形体偏痩，舌淡苔薄白。其治法是
A. 健脾化湿
B. 健脾和胃
C. 疏肝和胃
D. 消食导滞
E. 和脾助运

正确答案：E。和脾助运

解析：患儿主症为不思纳食，诊为厌食，除厌食外其他症状不著，精神正常。所以为厌食症初期脾失健运证，治宜调和脾胃，运脾开胃，即和脾助运（E对）。健脾化湿用于脾虚湿蕴（A错）。健脾和胃用于脾胃不和（B错）。疏肝和胃用于肝胃不和（C错）。消食导滞用于食积之证（D错）。